阵发性室性心动过速最常见的病因是
A. 二尖瓣脱垂
B. 冠心病
C. 心脏瓣膜病
D. 心力衰竭
E. 高钾血症

正确答案：B。冠心病

解析：阵发性室性心动过速最常见的病因是冠心病（B对）。二尖瓣脱垂（A错）、心脏瓣膜病（C错）、心力衰竭（D错）、高钾血症（E错）虽然也是阵发性室性心动过速的病因，但都不是最常见的。